可与茶叶中的鞣酸结合产生沉淀，饮茶会影响其吸收的药物是
A. 硫酸亚铁
B. 地西泮
C. 对乙酰氨基酚
D. 硝苯地平
E. 二甲双胍

正确答案：A。硫酸亚铁

解析：本题考查铁剂的使用。硫酸亚铁（A对）与茶叶中的鞣酸结合形成沉淀，因此服用硫酸亚铁时饮茶会减少药物的吸收。茶叶中含有大量的鞣酸、咖啡因、儿茶酚、茶碱，其中鞣酸能与药中的多种金属离子如钙、铁、钴、铋、铝结合而发生沉淀，从而影响药品的吸收。